强心苷的甾体母核特点是
A. A/B环多为反式稠合、B/C环为顺式稠合、C/D环多为顺式稠合
B. A/B环多为顺式稠合、B/C环为反式稠合、C/D环多为反式稠合
C. A/B环多为顺式稠合、B/C环为顺式稠合、C/D环多为反式稠合
D. A/B环多为反式稠合、B/C环为反式稠合、C/D环多为反式稠合
E. A/B环多为顺式稠合、B/C环为反式稠合、C/D环多为顺式稠合

正确答案：E。A/B环多为顺式稠合、B/C环为反式稠合、C/D环多为顺式稠合

解析：本题考查的是强心苷的结构特点。强心苷的甾体母核特点是A/B环多为顺式稠合、B/C环为反式稠合、C/D环多为顺式稠合（E对）。强心苷元部分的结构特征：强心苷由强心苷元与糖缩合而成。天然存在的强心苷元是C₁₇侧链为不饱和内酯环的甾体化合物。其结构特点如下。甾体母核A、B、C、D四个环的稠合方式为A/B环有顺、反两种形式，但多为顺式；B/C环均为反式；C/D环多为顺式。